非肽类的AT₁受体拮抗药物是
A. 硝苯地平
B. 卡托普利
C. 普萘洛尔
D. 氯沙坦
E. 氢氯噻嗪

正确答案：D。氯沙坦

解析：本题考查非肽类的AT₁受体拮抗药。氯沙坦（D对）是非肽类的AT₁受体拮抗药，能拮抗血管紧张素Ⅱ与AT₁受体结合，松弛血管平滑肌、对抗醛固酮的分泌，减少水钠潴留，降低血压、逆转心肌肥厚，减轻心力衰竭等。硝苯地平（A错）是第一代钙拮抗剂，为抗高血压、防治心绞痛药物。卡托普利（B错）是血管紧张素转化酶抑制剂类降血压药，通过减少血管紧张素Ⅱ的生成，抑制缓激肽的降解，发挥扩血管作用。普萘洛尔（C错）为β受体拮抗剂，用于治疗多种原因所致的心律失常。氢氯噻嗪（E错）为利尿药，抑制远曲小管对Na⁺和Cl⁻重吸收，临床用于各种原因的轻中度水肿以及高血压。